临床上最常见的颞下颌关节脱位是
A. 陈旧性脱位
B. 复发性脱位
C. 急性前脱位
D. 颞下颌关节强直
E. 不可复性关节盘前移位

正确答案：C。急性前脱位

解析：本题考查颞下颌关节脱位。急性前脱位（C对）是临床最常见的颞下颌关节脱位。